关于唑吡坦作用特点的说法，错误的是
A. 唑吡坦属于γ-氨基丁酸A型受体激动剂
B. 唑吡坦具有镇静、催眠作用，抗焦虑作用
C. 口服唑吡坦后消化道吸收迅速
D. 唑吡坦血浆蛋白结合率高
E. 唑吡坦经肝代谢、肾排泄

正确答案：B。唑吡坦具有镇静、催眠作用，抗焦虑作用

解析：本题考查吡唑坦的作用特点。唑吡坦具有镇静、催眠作用，无抗焦虑作用（B错，为本题正确答案）；唑吡坦属于γ-氨基丁酸A型受体激动剂（A对），为含有咪唑并吡啶结构的镇静催眠药，口服后消化道吸收迅速（C对），血浆蛋白结合率高（D对），主要经肝脏代谢，经肾脏排出（E对）。